治疗皮水一身悉肿，肢体沉重，心腹胀满，上气喘急，小便不利，舌苔白腻，脉沉缓。应首选
A. 十枣汤
B. 五苓散
C. 实脾散
D. 五皮散
E. 真武汤

正确答案：D。五皮散

解析：五皮散证由脾失健运，水停气滞，外溢肌肤所致。水饮泛溢肢体，则一身悉肿；水湿不化，气机壅塞，则心腹胀满；肺气不降，水道不通，则上气喘急、小便不利；肢体沉重，苔白腻，脉沉缓等皆水湿停聚之象。法当健脾渗湿，利水消肿，理气除满。用五皮散治疗。（D对）。十枣汤（A错）的功用为攻逐水饮，主治1.悬饮证；2.水肿证。五苓散（B错）的功用为利水渗湿，温阳化气，主治蓄水证；痰饮；水湿内停证。实脾散（C错）的功用为温阳健脾，行气利水，主治脾肾阳虚，水气内停之阴水。真武汤（E错）的功用为温阳利水，主治阳虚水泛证。